某人血浆中含有抗A、抗B凝集素，则此人的血型可能是
A. A₁型
B. B型
C. AB型
D. A₂B型
E. O型

正确答案：E。O型